所引起的菌痢多数症状轻，非典型病例较多者是
A. 痢疾志贺菌
B. 福氏志贺菌
C. 变形杆菌
D. 鲍氏志贺菌
E. 宋内志贺菌

正确答案：E。宋内志贺菌

解析：目前我国流行的优势菌群为福氏志贺菌和宋氏志贺菌，城市以宋氏志贺菌为主，农村以福氏志贺菌为主。所有痢疾杆菌均可产生内毒素，引起全身严重反应如发热、毒血症及休克等。外毒素亦称志贺毒素，具有肠毒性、神经毒性、细胞毒性，引起相应的临床表现。福氏志贺菌感染易转为慢性，宋氏志贺菌（E对）感染多为不典型发作。痢疾志贺菌毒力最强，临床症状较严重。痢疾志贺菌（A错）能产生最强外毒素，具有肠毒性、神经毒性、细胞毒性，毒力最强，临床症状较严重。福氏志贺菌（B错）感染后易转为慢性，为目前国内常见的痢疾杆菌菌群，具有强烈的内毒素，临床症状较典型。变形杆菌（C错）不属于细菌性痢疾的致病菌群。鲍氏志贺菌（D错）具有强烈的内毒素，临床症状较典型。